白芍的主治病证有
A. 自汗，盗汗
B. 阳亢目眩
C. 阴虚燥咳
D. 血虚萎黄
E. 四肢拘急作痛

正确答案：A、B、D、E。自汗，盗汗；阳亢目眩；血虚萎黄；四肢拘急作痛

解析：本题考查的是白芍的主治病证。白芍的主治病证有自汗，盗汗（A对）、阳亢目眩（B对）、血虚萎黄（D对）与四肢拘急作痛（E对）。白芍：【主治病证】（1）血虚萎黄，月经不调，痛经，崩漏。（2）阴虚盗汗，表虚自汗。（3）肝脾不和之胸胁脘腹疼痛，或四肢拘急作痛。（4）肝阳上亢之头痛眩晕。阿胶：【主治病证】（1）血虚眩晕、心悸。（2）吐血，衄血，便血，崩漏，妊娠胎漏。（3）阴虚燥咳（C错）或虚劳喘咳。（4）阴虚心烦、失眠。